鉴定含有多种未知成分的挥发油的有效方法是
A. 气相色谱-质谱联用法
B. 薄层色谱法
C. 液相色谱-紫外光谱联用法
D. 纸色谱法
E. 重结晶法

正确答案：A。气相色谱-质谱联用法

解析：本题考查的是气相色谱-质谱联用法。鉴定含有多种未知成分的挥发油的有效方法是气相色谱-质谱联用法（A对）。对于挥发油中许多未知成分，同时又无标准品作对照时，则应选用气相色谱-质谱联用技术进行分析鉴定。薄层色谱法（B错）系将供试品溶液点于薄层板上，在展开容器内用展开剂展开，使供试品所含成分分离，所得色谱图与适宜的对照物（对照品或对照药材）按同法所得的色谱图对比，并可用薄层扫描仪进行扫描，用于鉴别、检查或含量测定。薄层色谱法因其快速、简便和灵敏，是目前中药鉴定中用于定性鉴别使用最多的色谱法之一。纸色谱法（D错）实质上也是液液萃取法的原理，只是两相中其中一相以固态为基质，与某种液相形成饱和状态，进而达到分离的目的。重结晶法（E错）从不纯的结晶经过进一步加溶剂结晶进行精制处理得到较纯结晶的过程称为重结晶。